关于翼下颌间隙感染的描述中，错误的是
A. 切开引流常采用口内切开，一般口外切口较少采用
B. 脓肿形成，临床很难直接触及波动
C. 可由下牙槽神经阻滞麻醉时消毒不严引起
D. 常是先有牙痛史，继之出现开口受限
E. 感染来源常见为下颌智牙冠周炎及下颌磨牙尖周炎症扩散所致

正确答案：A。切开引流常采用口内切开，一般口外切口较少采用

解析：翼下颌间隙口内切开因受张口度的限制，较少采用；口外途径具有易于暴露间隙及姿势引流的优点。掌握“翼下颌间隙、颞下间隙感染”知识点。